药品质量标准中属于药物特性检查的项目是
A. 氯化物
B. 细菌内毒素
C. 有关物质
D. 结晶性
E. 熔点

正确答案：D。结晶性

解析：本题考查药品标准检查项下的内容。药品质量标准中属于药物特性检查的项目是结晶性（D对）。特性检查法系指采用适当的方法检查药品的固有理化特性是否发生改变以及发生改变的程度。《中国药典》通则0900系列收载有溶液颜色检查法（通则0901）、澄清度检查法（通则0902）、不溶性微粒检查法（通则0903）、可见异物检查法（通则0904）、崩解时限检查法（通则0921）、溶出度与释放度测定法（通则0931）、含量均匀度检查法（通则0941）、最低装量检查法（通则0942）、结晶性检查法（通则0981）、粒度和粒度分布测定法（通则0982）等18项检查或测定法。一般杂质是指在自然界中分布广泛、在多种药品的生产中可能引入的杂质。氯化物（A错）、硫酸盐、铁盐、砷盐及重金属均属于自然界中常见的杂质，属于一般杂质。生物检查法是主要针对灭菌制剂的安全性的检查，《中国药典》通则收载有无菌检查法（通则1101）、异常毒性检查法（通则1141）、热原检查法（通则1142）、细菌内毒素（B错）检查法（通则1143）、过敏反应检查法（通则1147）等，共计16项检查法。特殊杂质是指在特定药物的生产和贮藏过程中引入的杂质，多指有关物质（C错）。